巴比妥类药物引起呼吸抑制，属于
A. 副作用
B. 毒性反应
C. 过敏反应
D. 耐受性
E. 成瘾性

正确答案：B。毒性反应

解析：毒性反应是指药物剂量过大或用药时间过长而引起的机体损害性反应，一般比较严重。毒性反应的表现主要是对神经、消化、血液、循环系统及肝、肾等造成功能性或器质性损害，甚至可危及生命。巴比妥类较大剂量或静脉注射较快时可抑制呼吸中枢，导致呼吸困难，作用程度与剂量成正比（B对）。